佝偻病激期（活动期）临床表现主要是
A. 生长中的骨骼改变、肌肉松弛和神经兴奋性改变
B. 神经症状、骨骼改变
C. 易激惹、烦躁、多汗、枕部秃发
D. 颅骨软化、鸡胸、X形腿
E. 骨缝、前、后囱闭合及出牙延迟

正确答案：D。颅骨软化、鸡胸、X形腿

解析：颅骨软化、鸡胸、X形腿（D对A错）见于佝偻病激期，生长中的骨骼改变、肌肉松弛可见于佝偻病激期（活动期），但神经兴奋性改变属于佝偻病初期的表现。神经症状（B错）一般见于佝偻病初期。易激惹、烦躁、多汗、枕部秃发（C错）一般见于佝偻病初期。骨缝、前、后囱闭合及出牙延迟（E错）也是佝偻病的表现，但是一般发生于1.5岁之后，不是激期的主要表现。